在血液和精神情志方面关系密切的两脏是
A. 心与肺
B. 心与肾
C. 心与脾
D. 心与肝
E. 肺与脾

正确答案：D。心与肝

解析：心与肝的关系，主要表现在血液运行和精神情志方面（D对）：①血液运行：心主血脉，推动血行，则肝有所藏。肝藏血，调节血量，防止出血；肝疏泄，调畅气机，促进血行，使心主血脉功能正常。两者共同维持血液的正常运行。②精神情志：心藏神，主精神活动；肝主疏泄，调畅情志。两者协调，维持正常的精神情志活动。心血充足，心神清明，有助于肝主疏泄；肝气条达，肝血充盈，有助于心神内守。两者相互为用，则精神饱满，情志舒畅；心与肺的关系主要体现为气与血的关系（A错）。心与肾的关系主要表现为水火既济、精神互用、君相安位等方面（B错）。心与脾的关系，主要表现在血液生成与运行方面的相互为用、相互协同（C错）。肺与脾的关系，主要表现在气的生成与津液代谢两个方面（E错）。